男性，32岁，3小时前从5米高处跌下，左腰部撞到石块上，当时无昏迷，现血压正常，感左腰部疼痛伴轻压痛，尿常规RBC+/HP，最可能的诊断是
A. 肾挫伤
B. 肾部分裂伤
C. 肾全层裂伤
D. 肾蒂断裂
E. 肾蒂伤伴输尿管损伤

正确答案：A。肾挫伤

解析：本例患者受伤并不是很重，无昏迷，血压正常，只是稍微有点血尿，RBC+/HP为高倍镜下可见红细胞，因此应诊断为肾挫伤（A对）；肾部分裂伤（B错）会出现明显血尿，而非镜下血尿；肾全层裂伤（C错）常出现肾周围血肿、血尿和尿外渗；肾蒂断裂（D错）可出现大出血、休克；肾蒂伤伴输尿管损伤（E错）病情危急，出现大量出血及腹水。